女，65岁。因大量蛋白尿、外院肾活检示膜性肾病1周，予泼尼松60mg/日治疗3周，突发右侧腰痛伴肉眼血尿1天。查体：右肾叩击痛（+），尿蛋白（++++）。尿沉渣镜检RBC满视野，血Alb15g/L，血肌酐95μmol/L，B超示右肾增大。对明确血尿原因最有价值的检查是
A. 清洁中段尿培养
B. 静脉肾盂造影
C. 肾血管彩超
D. 重复肾活检
E. 尿查肿瘤细胞

正确答案：C。肾血管彩超

解析：65岁老年女性患者，因大量蛋白尿、外院肾活检示膜性肾病1周，于泼尼松60mg/日治疗3周，突发右侧腰痛伴肉眼血尿1天。查体：右肾叩击痛（+），尿蛋白（++++）。尿沉渣镜检RBC满视野，血Alb15g/L，血肌酐95μmol/L，B超示右肾增大。综合患者病史体征及辅助检查结果，考虑患者为膜性肾病合并肾静脉血栓，急性肾静脉血栓主要症状为突发腰痛、伴有肾叩击痛、高蛋白尿、肉眼血尿等。此时对明确血尿原因最有价值的检查是肾血管B超（C对）。清洁中段尿培养（A错）可明确有无细菌尿。静脉肾盂造影（B错）可了解肾盂、输尿管及膀胱形态。患者已行肾活检明确病理类型，无需重复肾活检（D错）。泌尿系统肿瘤常有无痛性血尿，故排除尿查肿瘤细胞（E错）。